下列关于使用肾上腺素治疗血管神经性水肿的使用方法中，正确的是
A. 皮下注射0.1%肾上腺素0.25～0.5ml
B. 皮下注射0.1%肾上腺素0.5～0.8ml
C. 皮下注射0.1%肾上腺素0.9～1.5ml
D. 皮下注射0.1%肾上腺素1.8～2.0ml
E. 不可使用激素

正确答案：A。皮下注射0.1%肾上腺素0.25～0.5ml

解析：明确并隔离变应原，可接触症状，防止复发。对于症状轻者，可不予药物治疗。对于症状严重、体征广泛者，可予皮下注射0.1%肾上腺素0.25～0.5ml。用肾上腺素可以使黏膜和皮肤的血管收缩，并可阻止生物活性物质的释放以减少渗出，从而可抑制水肿。掌握“血管神经性水肿”知识点。